既化痰止咳，又和胃降逆的药是
A. 紫菀
B. 天竺黄
C. 礞石
D. 枇杷叶
E. 款冬花

正确答案：D。枇杷叶